男孩，8岁。高热伴右下肢剧痛不能活动2天。查体：T39.4℃，P135次/分，精神不振，右胫骨上端微肿，有深压痛，白细胞26×10⁹/L，血沉80mm/h，X线检查未见明显异常，核素扫描显示右胫骨上端有浓聚区。最可能的诊断是
A. 风湿性关节炎
B. 膝关节结核
C. 急性化脓性骨髓炎
D. 恶性骨肿瘤
E. 急性化脓性关节炎

正确答案：C。急性化脓性骨髓炎

解析：8岁患儿，高热，查体：T39.4度（高于正常值36.0°～37.0°）、P135次/分（高于正常值60～100次/分）、白细胞26×10⁹/L（高于正常值4～10×10⁹/L）、血沉80mm/h（高于男性正常值0～15mm/h），提示可能存在感染。右下肢剧痛、查体见右胫骨上端微肿、有深压痛（提示感染部位可能在右胫骨上端），核素扫描显示右胫骨上端有浓聚区（提示病灶在右胫骨上），结合患者症状、体征和影像学表现，该患者最可能的诊断为急性化脓性骨髓炎（C对）。（1）小娃+全身中毒症状（寒战高热WBC↑）+无肿胀／微肿——急性血源性骨髓炎（好发于膝关节上下） （2）小娃+全身中毒症状+肿胀明显+浮髌实验（+）——化脓性关节炎（好发于膝髋关节）。风湿性关节炎（A错）是一种常见的结缔组织炎症，临床以关节和肌肉游走性疼痛为特征，可反复发作并累及心脏。膝关节结核（B错）起病缓慢，有低热、乏力、盗汗等结核中毒症状，关节镜检查可确诊。恶性骨肿瘤（D错）多无全身中毒症状，X线多有骨质破坏。化脓性关节炎（E错）表现与急性化脓性骨髓炎相似，但受累关节局部红、肿、热、痛症状较明显，浮髌试验可阳性。